某男，58岁。大便干结，小便短赤，腹胀腹痛，口干口臭。舌红苔黄腻，脉滑数。辨证为热结肠胃，治宜选用的中成药是
A. 清宁丸
B. 加味保和丸
C. 槟榔四消丸
D. 麻仁滋脾丸
E. 九制大黄丸

正确答案：D。麻仁滋脾丸

解析：本题考查的是便秘的辨证论治。辨证为热结肠胃，治宜选用的中成药是麻仁滋脾丸（D对）。题中描述的病证为便秘热秘。便秘热秘：【中成药应用】常用中成药有麻仁胶囊、麻仁润肠丸、麻仁滋脾丸、通幽润燥丸、清泻丸、复方芦荟胶囊。加味保和丸（B错）与槟榔四消丸（C错）为胃痛饮食伤胃证的中成药应用。胃痛饮食伤胃证：【中成药应用】常用中成药有槟榔四消丸（大蜜丸）、开胸顺气丸、沉香化滞丸、加味保和丸。清宁丸（A错）与九制大黄丸（E错）为妊娠禁用、忌用中成药。